下列各项可见口干但欲漱水不欲咽症状的是
A. 湿热
B. 阴虚
C. 痰饮
D. 瘀血
E. 温病营分证

正确答案：D。瘀血

解析：因瘀血（D对）内阻，气化不利，津液输布异常，不能上承于口，故见口干；体内津液本不匮乏，故但欲漱水而不欲咽。阴虚证（B错），因阴津亏虚，虚火内扰，故见口干不欲饮。痰饮病（C错），因脾胃阳虚，饮停胃肠，致津液输布障碍，不能上承于口，故见口渴喜热饮；饮后水停胃肠更甚，胃失和降而上逆，故水入即吐。温病见口渴而不多饮，为营分证（E错）。因热入营分，灼伤营阴，故见口渴；但邪热蒸腾营阴上潮于口，故不多饮。